HBV感染后最早产生的抗体是
A. 抗-HBcIgM
B. 抗-HBc
C. 抗-HBcIgG
D. 抗-HBe
E. 抗-HBs

正确答案：A。抗-HBcIgM

解析：抗-HBcIgM（A对）于感染后早期即可刺激机体产生，是HBV急性感染及慢性感染病情活动的标志；抗-HBc（B错）包括抗-HBcIg M和抗-HBcIgG；抗-HBcIgG（C错）出现较迟，见于急性感染恢复期和慢性感染期；抗-HBe（D错）多于感染后10周后出现；HBsAg于感染后6个月内消失抗-HBs（E错）在其消失后数天至数月可检测到。